人幼年时缺乏哪种激素可导致侏儒症
A. 甲状腺激素
B. 生长激素
C. 胰岛素
D. 催乳素
E. 维生素D₃

正确答案：B。生长激素